含有多糖类免疫调节活性成分的是
A. 牛黄
B. 熊胆
C. 麝香
D. 人参
E. 蟾蜍

正确答案：E。蟾蜍

解析：本题考查的是蟾蜍的化学成分。含有多糖类免疫调节活性成分的是蟾蜍（E对）。蟾蜍中含多糖类免疫调节活性成分。蟾蜍的药用部分为其分泌物蟾酥。蟾酥的化学成分复杂，主要成分有蟾蜍甾二烯类、强心甾烯蟾毒类、吲哚碱类、甾醇类以及肾上腺素、多糖、蛋白质、氨基酸和有机酸等，前两类成分具有强心作用。《中国药典》以蟾毒灵、华蟾酥毒基和脂蟾毒配基为指标成分进行含量测定，要求总量不得少于7.0%。牛黄（A错）约含8%胆汁酸，主要成分为胆酸、去氧胆酸和石胆酸。此外，还含有7%SMC及胆红素，胆固醇，麦角固醇，多种氨基酸（如丙氨酸、甘氨酸、牛磺酸、精氨酸、天冬氨酸、蛋氨酸等）和无机盐等。《中国药典》以胆酸和胆红素为牛黄的质量控制成分，要求胆酸含量不少于4.0%，胆红素含量不得少于25.0%。熊胆（B错）的化学成分为胆汁酸类的碱金属盐及胆甾醇和胆红素。从生物活性方面讲，其主要有效成分为牛磺熊去氧胆酸，此外还有鹅去氧胆酸、胆酸和去氧胆酸。麝香（C错）的化学成分较为复杂，其中的麝香酮（L-3-甲基十五环酮）是天然麝香的有效成分之一。《中国药典》以麝香酮为指标成分进行含量测定，要求麝香酮含量不得少于2.0%。此外，麝香中还含有降麝香酮，麝香吡啶和羟基麝香吡啶A、B等10余种雄甾烷衍生物，而且还有多肽、脂肪酸、胆甾醇及其酯和蜡等。人参（D错）含有皂苷、多糖和挥发油等多种化学成分，人参皂苷为人参的主要有效成分之一。《中国药典》以人参皂苷为指标成分对人参、红参和人参叶进行含量测定。其中，人参和红参的质量控制成分为人参皂苷Rg₁、人参皂苷Re和人参皂苷Rb₁。例如，要求人参中人参皂苷Rg₁和人参皂苷Re的总量不得少于0.30%，人参皂苷Rb₁不得少于0.20%。